以脏腑部位及功能划分阴阳，则肾属
A. 阳中之阳
B. 阴中之阴
C. 阳中之阴
D. 阴中之阳
E. 阴中之至阴

正确答案：B。阴中之阴

解析：依据中土五行模式，将五脏配与方位、四时以及太少阴阳：肝属木，位东方，通于春，属阴中之阳的少阳（D错）；心属火，位南方，通于夏，属阳中之阳的太阳（A错）；肺属金，位西方，通于秋，属阳中之阴的少阴（C错）；肾属水，位北方，通千冬，属阴中之阴的太阴（B对）；脾属土，居中央，主四时，为阴中之至阴（E错）。如此则形成了心上肾下、左肝右肺、脾居于中的四时五脏体系；同时，创立脾为孤脏，主于四时，以灌四傍，为脏气升降之枢等理论，对于脾胃学说的发展具有重要启示和指导作用。